某女，79岁。心前区隐痛，劳则加重，憋气，神疲乏力，自汗。诊断为胸痹，证属气虚血瘀。根据望诊理论与临床实践，其常见的舌象是
A. 舌质淡紫
B. 舌质红
C. 舌质淡白
D. 舌质淡红
E. 舌质红绛

正确答案：A。舌质淡紫

解析：本题考查胸痹之气虚血瘀证的症状。根据望诊理论与临床实践，其常见的舌象是舌质淡紫（A对）。胸痹之气虚血瘀证【症状】胸痛隐隐，遇劳则发，神疲乏力，气短懒言，心悸自汗。舌胖有齿痕，色淡暗，苔薄白，脉弱而涩，或结、代。喘证之痰热壅肺证【症状】喘咳气涌，胸部胀痛，痰稠黏色黄，或夹血痰，伴胸中烦闷、身热、有汗、口渴喜冷饮、咽干、面红、尿赤、便秘。舌质红（B错），苔薄黄腻，脉滑数。消渴之气阴两虚证【症状】口渴引饮，咽干口燥，多食善饥，倦怠乏力，便溏溲多，或形体消瘦。舌质淡红（D错），苔白而干，脉弱。心在窍为舌：舌为心之外候，又称“舌为心之苗”。舌的主要功能是主司味觉，表达语言。心的经脉上通于舌，舌的功能要靠心的气血之充养才能维持。由于舌面无表皮覆盖，血脉又很丰富，因此，从舌质的色泽即可以直接察知气血的情况，并判断心的生理功能正常与否。心的功能正常，则舌体红活荣润，柔软灵活，味觉灵敏，语言流利。若心有病变，则反映于舌。例如，心的阳气不足，则舌质淡白（C错）胖嫩；心的阴血不足，则舌质红绛（E错）瘦瘪；心火上炎，则舌红，甚则生疮；心血瘀阻，则舌质暗紫，或有瘀斑；心主神志的功能异常，则舌卷、舌强、语謇或失语等。舌不但为心之苗，又与其他脏腑的关系十分密切。因此，通过望舌亦可有助于对其他脏腑病变的诊断。